甲状腺功能减退症的表现
A. FT4正常、FT3正常、TSH正常
B. FT4正常、FT3正常、TSH减低
C. FT4减低、FT3减低、TSH减低
D. FT4减低、FT3减低、TSH增高
E. FT4减低、FT3减低、TSH正常

正确答案：D。FT4减低、FT3减低、TSH增高

解析：甲状腺功能减退症血清TSH增高，TT4和FT4均降低。血清TT3、FT3早期正常，晚期减低。故答案选择FT4减低、FT3减低、TSH增高（D对）。